下列关于淋病奈瑟球菌的描错误的是
A. 多在中性粒细胞内
B. 为革兰氏阴性球菌
C. 直径0.6～0.8μm
D. 呈咖啡豆状
E. 大多有鞭毛，无菌毛

正确答案：E。大多有鞭毛，无菌毛

解析：淋病奈瑟球菌形态与染色：革兰氏阴性球菌，多在中性粒细胞内，直径0.6～0.8μm，呈咖啡豆状（或肾形）成双排列，大多有菌毛，无鞭毛，不形成芽胞，无荚膜。掌握“肠球菌属及奈瑟菌属”知识点。